具有疏风散邪、清热解毒功用的方剂是
A. 黄连解毒汤
B. 普济消毒饮
C. 清瘟败毒饮
D. 青蒿鳖甲汤
E. 龙胆泻肝汤

正确答案：B。普济消毒饮

解析：普济消毒饮（B对）功效为疏风散邪，清热解毒，主治大头瘟；黄连解毒汤（A错）功效为泻火解毒；清瘟败毒饮（C错）功效为清热解毒，凉血泻火；青蒿鳖甲汤（D错）功效为养阴透热；龙当泻肝汤（E错）功效为倾泻肝胆实火，清利肝经湿热。